系统性红斑狼疮，狼疮肾炎（病理为Ⅳ型）首选的免疫抑制剂为
A. 环磷酰胺
B. 甲氨蝶呤
C. 长春新碱
D. 依木兰
E. 雷公藤

正确答案：A。环磷酰胺

解析：系统性红斑狼疮伴狼疮性肾炎，治疗首选糖皮质激素联合免疫抑制剂治疗，免疫抑制剂首选环磷酰胺（A对）。甲氨蝶呤（B错）为类风湿关节炎首选用药。长春新碱（C错）为抗恶性肿瘤药物，免疫抑制作用较小。依木兰（D错）即硫唑嘌呤与雷公藤（E错）可用于系统性红斑狼疮的治疗，但非首选。